男，48岁，间断性腹痛4年，加重4小时，腹痛多于进食后1小时发生，可自行缓解，未诊治。4小时前进食后突发剧烈疼痛，迅速波及全腹。查体：T36.8℃，P92次/分，R18次/分，BP：160/80mmHg。查体：全腹反跳痛，肌紧张，有局部压痛。引起腹痛的原因是
A. 急性心肌梗死
B. 急性胰腺炎
C. 胃溃疡穿孔
D. 急性冠心病
E. 急性胃粘膜病变

正确答案：C。胃溃疡穿孔

解析：患者间断性腹痛4年，加重4小时，腹痛多于进食后1小时发生，可自行缓解，考虑胃溃疡。4小时前进食后突发剧烈疼痛，迅速波及全腹。查体：全腹反跳痛，肌紧张，有局部压痛（腹膜刺激征）。考虑胃溃疡并穿孔（C对）。急性心肌梗死、急性冠心病会出现胸闷、气促、胸前区压榨感（AD错）。急性胰腺炎的腹痛发作一般不如溃疡急性穿孔者急骤，腹痛多位于上腹部偏左，并向背部放射。腹痛有一个由轻转重的过程，肌紧张程度相对较轻。血清、尿液和腹腔穿刺液淀粉酶明显升高，X线检查膈下无游离气体，CT、超声检查提示胰腺肿胀，周围渗出。（B错）。急性胃粘膜病变往往会有喝酒、服用非甾体止痛药病史（E错）。